不属于免疫缺陷病的疾病是
A. X-连锁慢性肉芽肿病
B. 艾滋病
C. 遗传性血管神经性水肿
D. 系统性红斑狼疮
E. X-连锁无丙种球蛋白血症

正确答案：D。系统性红斑狼疮

解析：免疫缺陷病（IDD）是由于遗传因素和其他多种原因造成免疫系统先天发育不全或后天损伤而导致的免疫成分缺失、免疫功能障碍所引起的临床综合症。按病因不同分为原发性免疫缺陷病（PIDD）和获得性免疫缺陷病（AIDD）两大类。原发性免疫缺陷病可分为八大类：①T、B细胞联合免疫缺陷，如X连锁重症联合免疫缺陷病、网状系统发育不良；②以抗体缺陷为主的免疫缺陷病，如X连锁无丙种球蛋白血症（XLA）（E对）、选择性IgA缺陷；③其他定义明确的免疫缺陷综合征，如共济失调毛细血管扩张症；④免疫失调性疾病；⑤吞噬细胞数量、功能先天性缺陷，如X连锁慢性肉芽肿病（A对）；⑥天然免疫缺陷；⑦自身炎性反应性疾病；⑧补体缺陷，如阵发性夜间血红蛋白尿、遗传性血管神经性水肿（C对）。获得性免疫缺陷病可由非感染性因素和感染性因素诱发，感染性因素中危害最大的是感染HIV后诱发的获得性免疫缺陷综合征（AIDS），即常称的艾滋病（B对）。系统性红斑狼疮（D错，为本题正确答案）是一种有多系统损害的慢性自身免疫性疾病，并不是免疫缺陷病。